脓色绿黑稀薄者，其病机为
A. 气血充足
B. 气火有余
C. 气血虚弱
D. 蓄毒日久损伤筋骨
E. 血络受损

正确答案：D。蓄毒日久损伤筋骨

解析：气血充足的脓液为黄柏质稠，色泽鲜明（A错）。气火有余的脓液为黄浊质稠，色泽不净（B错）。气血虚的脓液为黄白质稀，色泽洁净（C错）。蓄毒日久损伤筋骨的脓液为脓色绿黑稀薄（D对）。血络受损的脓液为脓中夹有瘀血（E错）。